代谢性碱中毒对机体的影响，下列哪项是不正确的？
A. 中枢神经系统兴奋
B. 血红蛋白氧离曲线左移
C. 呼吸加深加快
D. 血浆游离钙降低
E. 低钾血症

正确答案：C。呼吸加深加快

解析：代谢性碱中毒由于H+浓度降低，呼吸中枢受抑制，呼吸变浅变慢（C错，为本题正确答案）。血液pH升高可使血红蛋白与氧的亲和力增强，血红蛋白氧离曲线左移（B对），血红蛋白不易将结合的 02 释出造成脑组织缺氧，同时由于pH值增高,γ-氨基丁酸转氨酶活性增强，γ-氨基丁酸对中枢抑制减弱，表现为中枢神经系统兴奋（A对）。pH升高也可以导致Ca离子与血浆蛋白结合增多以及细胞内H+与细胞外K+交换，导致血浆游离钙降低（D对）和低钾血症（E对）。